可以用乙二胺四醋酸二钠滴定液测定含量的药物是
A. 氯化钠
B. 氯化钾
C. 硫酸锌
D. 氯化铵
E. 碘化钠

正确答案：C。硫酸锌